阳水病位在
A. 脾、肾
B. 肺、肾
C. 肺、脾
D. 心、肾
E. 心、肺

正确答案：C。肺、脾

解析：阳水病因多为风邪、疮毒、水湿，属表、属实，一般病程较短，病位在肺、脾（C对）。